判断某传染病者是否为院内感染引起的主要依据
A. 临床病症
B. 病程
C. 潜伏期
D. 检验结果
E. 传染期

正确答案：C。潜伏期

解析：本题考查潜伏期的流行病学意义。潜伏期（C对ABDE错）的长短可用来判断病人受感染的时间，用于追溯传染源和确定传播途径，可判断传染病是否为院内感染。